燃点低易燃的是
A. 松节油
B. 氯化钡
C. 氢氧化钠
D. 甘露醇
E. 乳酶生

正确答案：A。松节油

解析：本题考查易燃液体。易燃液体即燃点低，易于挥发和燃烧的液体，如乙醚、石油醚、乙醇、甲醇、松节油（A对）等。氯化钡（B错）是极毒性药品。氢氧化钠（C错）是有腐蚀性的药品。